针对于饮食习惯带来的牙齿酸蚀症的危害，以下预防方法错误的是
A. 酸性饮食的摄入最好安排在就餐以后
B. 餐后饮用牛奶
C. 使用含氟漱口水漱口
D. 咀嚼无糖口香糖
E. 选用刷毛软硬适度的牙刷

正确答案：A。酸性饮食的摄入最好安排在就餐以后

解析：不良的饮食习惯及口腔卫生习惯：酸性饮食的摄入最好安排在就餐期间，此时唾液的流量大，缓冲能力强。不要安排在两餐之间，尤其不应在晚上睡觉前；餐后喝牛奶能在一定程度上中和食物中的酸。可使用含氟漱口水漱口、咀嚼无糖口香糖等方法促进唾液分泌从而发挥唾液的缓冲作用；刷牙时宜用含氟浓度高而摩擦剂强度低的牙膏刷牙；选用刷毛软硬适度，对牙磨损较小的牙刷，采用正确的刷牙方法及合适的力度刷牙均能预防牙酸蚀症。掌握“酸蚀症的预防”知识点。